矽肺病理形态分型中没有以下哪一型
A. 结节型
B. 砂粒型
C. 弥漫间质纤维化型
D. 团块性
E. 进行性大块纤维化

正确答案：B。砂粒型

解析：本题考查矽肺的病理改变。矽肺的基本病理改变是矽结节形成和弥漫性间质纤维化（E对），矽结节是矽肺的特征性病理改变。矽肺病理形态可分为结节型（A对）、弥漫性间质纤维化型（C对）、矽性蛋白沉积和团块型（D对）。砂粒型（B错，为本题正确答案）说法错误，应注意辨析矽肺的不同病理特点。